槟榔的横断面显
A. 菊花心
B. 车轮纹
C. 朱砂点
D. 大理石样花纹
E. 云锦纹

正确答案：D。大理石样花纹

解析：本题考查的是槟榔药材的性状鉴别。槟榔的横断面显大理石样花纹（D对）。槟榔：【性状鉴别】药材呈扁球形或圆锥形。表面淡黄棕色或淡红棕色，具稍凹下的网状沟纹，底部中心有圆形凹陷的珠孔，其旁有一明显疤痕状种脐。质坚硬，不易破碎，断面可见棕色种皮与白色胚乳相间的大理石样花纹。气微，味涩、微苦。菊花心（A错）是指药材断面维管束与较窄的射线相间排列成细密的放射状纹理，形如开放的菊花，如黄芪、甘草、白芍等。车轮纹（B错）是指药材断面维管束与较宽的射线相间排列成稀疏整齐的放射状纹理，形如古代木质车轮，如防己、青风藤等。朱砂点（C错）是指药材断面散在的红棕色油点，如茅苍术。云锦纹（E错）为何首乌的切面特征。何首乌：【性状鉴别】药材呈团块状或不规则纺锤形。表面红棕色或红褐色，皱缩不平，有浅沟，并有横长皮孔样突起及细根痕。体重，质坚实，不易折断，切断面浅黄棕色或浅红棕色，显粉性，皮部有4～11个类圆形异型维管束环列，形成云锦状花纹，中央木部较大，有的呈木心。气微，味微苦而甘涩。